温病高热烦躁，痉厥，神昏谵语，治宜选用
A. 牛黄清心丸
B. 紫雪丹
C. 玉枢丹
D. 苏合香丸
E. 天麻钩藤饮

正确答案：B。紫雪丹

解析：“高热烦躁，痉厥，神昏谵语”是温病邪热内陷心包的表现，治宜清心开窍，方选紫雪丹（B对）。紫雪丹药性偏凉，长于止痉息风，泄热通便，多用于高热惊厥之症；牛黄清心丸长于清热解毒，开窍安神，为清热开窍之轻剂（A错）；玉枢丹长于祛秽解毒，开窍化痰（C错）；苏合香丸长于化湿辟秽开窍，为温开之品（D错）；天麻钩藤饮主治肝阳偏亢，肝风上扰证（E错）。